以下哪项不属于商业医疗保险的运作模式
A. 共同保险模式
B. 再保险模式
C. 直接保险模式
D. 独立保险模式
E. 以收定支模式

正确答案：E。以收定支模式

解析：商业医疗保险的形式根据其运作模式，可以分为与社会医疗保险经办机构合作承保的“共同保险模式”、“再保险模式”和商业化经营的“直接（独立）保险模式。掌握“医疗保障”知识点。